吡格列酮的作用是
A. 促进肝糖原合成
B. 促进脂肪组织摄取葡萄糖
C. 增强靶组织对胰岛素的敏感性
D. 刺激胰岛B细胞释放胰岛素
E. 促进储存胰岛素释放

正确答案：C。增强靶组织对胰岛素的敏感性

解析：吡格列酮属于噻唑烷类胰岛素增敏药，主要通过增加肌肉、脂肪等外周组织器官对胰岛素的敏感性（C对），提高组织对葡萄糖的利用而发挥降血糖作用，临床上主要用于有胰岛素抵抗的1型糖尿病或2型糖尿病。胰岛素增加葡萄糖的转运，加速葡萄糖的讲解和氧化，促进糖原的合成（A错）和贮存，抑制糖原的分解和异生，从而降低血糖浓度。双胍类降糖药可减少葡萄糖在肠道吸收，抑制糖原异生，促进组织对葡萄糖摄取（B错）和促进糖的无氧酵解而增加糖的利用。磺酰脲类降糖药可刺激胰岛B细胞释放胰岛素（D错），对胰岛功能完全丧失的患者无效。瑞格列奈是一种新型的胰岛素促分泌剂，可阻止胰岛B细胞膜上ATP敏感K⁺通道，抑制K⁺外流，使细胞膜去极化，引起电压依赖性Ca²⁺通道开放，Ca²⁺内流，促进储存的胰岛素释放（E错）。